女婴，5个月。今晨突然面肌、口角及眼角抽动约半分钟，抽后精神好，不发热，不吐。冬季出生，混合喂养，未加辅食。查体：体重7Kg，会笑，前囟平，有枕秃，双侧巴氏征阳性。最可能的诊断及进一步检查是
A. 败血症，做血培养
B. 癫痫，做脑电图
C. 中枢神经系统感染，做腰穿
D. 维生素D缺乏性手足抽搐症，查血钙
E. 低血糖，查血糖

正确答案：D。维生素D缺乏性手足抽搐症，查血钙

解析：女婴，5个月（6个月内）。今晨突然面肌、口角及眼角抽动约半分钟（维生素D缺乏性手足抽搐症的表现），抽后精神好，不发热，不吐。冬季出生（日照不足），混合喂养，未加辅食（食物中补充维生素 D 不足）。查体：体重7kg，会笑，前囟平（前囟增大、闭合延迟），有枕秃（初期神经兴奋性增高，易激惹、烦闹、汗多刺激头皮而摇头产生），双侧巴氏征阳性（神经兴奋性增高），考虑诊断为维生素D缺乏性手足抽搐症，进一步检查是查血钙（D对）。